下列不属于Th2细胞分泌细胞因子的是
A. IL-4
B. IL-5
C. IL-6
D. IL-10
E. IFN-γ

正确答案：E。IFN-γ

解析：Th2：在IL-4的诱导下，Th分化为Th2。Th2通过分泌IL-4、5、6、10促进B细胞的增殖、分化和抗体的生成。Th2分泌的IL-4和IL-5可诱导IgE的生成和嗜酸性粒细胞的活化，在变态反应及抗寄生虫感染中发挥重要作用。特应性皮炎和支气管哮喘与Th2细胞因子分泌过多有关。掌握“T淋巴细胞”知识点。